正确描述声门裂的是
A. 是左、右两侧前庭襞之间的裂隙
B. 是同侧声襞与前庭襞之间的裂隙
C. 是声襞与前庭襞之间的外方突出的间隙
D. 是两侧声襞之间的裂隙
E. 是两侧声韧带之间的裂隙

正确答案：D。是两侧声襞之间的裂隙

解析：声门裂是两侧声襞之间的裂隙（D对）。